瞳孔开大肌位于
A. 角膜
B. 巩膜
C. 虹膜
D. 脉络膜
E. 视网膜虹膜部

正确答案：C。虹膜

解析：瞳孔开大肌位于虹膜（C对）。